高蛋白饮食在肠内产生氨基酸，会影响其吸收、降低疗效的药物是
A. 维A酸片
B. 左旋多巴片
C. 地衣芽孢杆菌活菌胶囊
D. 非洛地平片
E. 去氨加压素片

正确答案：B。左旋多巴片

解析：本题考查饮食对药物疗效的影响。高蛋白食物在肠内产生大量氨基酸，干扰左旋多巴（B对）由血浆至中枢神经的转移，阻碍吸收。维A酸（A错）为脂溶性维生素，多食脂肪性食物可促进药物吸收，增加疗效。地衣芽孢杆菌活菌胶囊（C错）服用期间不可饮茶。葡萄柚汁主要影响CYP3A4代谢，同时可抑制CYP3A4的活性，葡萄柚汁对非洛地平（D错）普通片、缓释片、薄膜衣片均有影响。去氨加压素（E错）服药期间应限制饮水。